《药品临床试验管理规范》的英文缩写为
A. GLP
B. GUP
C. GEP
D. GRP
E. GCP

正确答案：E。GCP

解析：本题考查《药品临床试验管理规范》的英文缩写。《药品临床试验管理规范》的英文缩写为GCP（E对）。GLP（A错）是《药物非临床研究质量管理规范》的英文缩写。GUP（B错）是《药品使用质量管理规范》的英文缩写。